阳虚湿盛的舌象是
A. 舌红苔白滑
B. 舌淡嫩苔白滑
C. 舌边红苔黑润
D. 舌红瘦苔黑
E. 舌绛苔黏腻

正确答案：B。舌淡嫩苔白滑

解析：舌红多为湿热或阴虚，苔白滑为外感寒湿或脾肾阳虚，水湿内停（A错）。舌淡嫩为阳虚水湿内停，苔白滑为外感寒湿或脾肾阳虚，水湿内停，舌淡嫩苔白滑为阳虚湿盛（B对）。舌边红多为肝经有热，苔黑润为寒湿内盛所致（C错）。舌红瘦为阴虚火旺，苔黑为阴寒内盛或里热炽盛（D错）。舌绛为里热亢盛或阴虚火旺，苔黏腻为湿浊所致（E错）。